治疗咽喉红肿疼痛，兼有肺热咳嗽痰多者，应首选
A. 射干
B. 鱼腥草
C. 马勃
D. 板蓝根
E. 山豆根

正确答案：A。射干

解析：咽喉红肿疼痛，治宜利咽，肺热咳嗽痰多，治宜清肺热止咳化痰。射干具有清热解毒，消痰，利咽的功效（A对）。鱼腥草具有清热解毒，消痈排脓，利尿通淋的功效，无利咽止咳之功（B错）。马勃具有清热解毒，利咽，止血的功效，无止咳化痰之功（C错）。板蓝根具有清热解毒，凉血，利咽的功效，无止咳化痰之功（D错）。山豆根具有清热解毒，利咽消肿的功效，无止咳化痰之功（E错）。